在药品批发企业中，人员资质要求为“应当是具有大学本科学历、执业药师资格和3年以上药品经营质量管理工作经验”的是
A. 法定代表人或企业负责人
B. 质量管理人员
C. 企业质量管理部门负责人
D. 企业质量负责人

正确答案：D。企业质量负责人

解析：本题考查的是药品批发企业经营和质量管理人员的资质要求。在药品批发企业中，人员资质要求为“应当是具有大学本科学历、执业药师资格和3年以上药品经营质量管理工作经验”的是企业质量负责人（D对）。药品批发企业企业质量负责人：具有大学本科以上学历、执业药师资格和3年以上药品经营质量管理工作经历，在质量管理工作中具备正确判断和保障实施的能力。药品批发企业企业负责人（A错）：具有大学专科以上学历或者中级以上专业技术职称，经过基本的药学专业知识培训，熟悉有关药品管理的法律法规及药品GSP。药品批发企业质量管理工作人员（B错）：具备药学中专或者医学、生物、化学等相关专业大学专科以上学历或者具有药学初级以上专业技术职称。药品批发企业企业质量管理部门负责人（C错）：具备执业药师资格和3年以上药品经营质量管理工作经历，能独立解决经营过程中的质量问题。